镜下表现为息肉由大量成纤维细胞和胶原纤维构成，其中散在淋巴细胞、浆细胞浸润，表面为被覆鳞状上皮。此为以下哪项的病理表现
A. 上皮型牙髓息肉
B. 慢性闭锁性牙髓炎
C. 溃疡型牙髓息肉
D. 慢性溃疡性牙髓炎
E. 急性牙髓炎

正确答案：A。上皮型牙髓息肉

解析：本题考查慢性牙髓炎的病理变化。镜下表现为息肉由大量成纤维细胞和胶原纤维构成，其中散在淋巴细胞、浆细胞浸润，表面为被覆鳞状上皮。此为上皮型牙髓息肉（A对）的病理表现。上皮型牙髓息肉即上皮型慢性增生性牙髓炎：肉眼观察呈粉红色较坚实，探之不易出血。显微镜下见息肉由大量成纤维细胞和胶原纤维构成，其中散在淋巴细胞、浆细胞浸润，表面被覆复层鳞状上皮。